下列关于利巴韦林的药理作用及临床应用说法不正确的是
A. 是一种人工合成的鸟苷类衍生物
B. 抗病毒谱较窄
C. 对多种DNA与RNA病毒有效
D. 可以抗甲型肝炎病毒与丙型肝炎病毒
E. 可以治疗呼吸道合胞病毒引起的肺炎

正确答案：B。抗病毒谱较窄

解析：利巴韦林是一种人工合成的鸟苷类衍生物，为光谱抗病毒药，对多种DNA和RNA病毒有效，包括甲型、丙型肝炎病毒，可以治疗呼吸道合胞病毒肺炎。掌握“氟康唑、利巴韦林及阿昔洛韦”知识点。